呈不规则的段，茎呈方柱形，外表面淡黄绿色或淡紫红色，被短柔毛，切面类白色，叶多脱落，穗状轮伞花序，气芳香，味微涩而辛凉的饮片是
A. 鱼腥草
B. 益母草
C. 金钱草
D. 荆芥
E. 半枝莲

正确答案：D。荆芥

解析：本题考查的是荆芥饮片的性状鉴别。呈不规则的段，茎呈方柱形，外表面淡黄绿色或淡紫红色，被短柔毛，切面类白色，叶多脱落，穗状轮伞花序，气芳香，味微涩而辛凉的饮片是荆芥（D对）。荆芥：【性状鉴别】饮片呈不规则的段。茎呈方柱形，外表面淡黄绿色或淡紫红色，被短柔毛。切面类白色。叶多已脱落。穗状轮伞花序。气芳香，味微涩而辛凉。鱼腥草（A错）：【性状鉴别】饮片鲜鱼腥草茎呈圆柱形；上部绿色或紫红色，下部白色，节明显，下部节上生有须根，无毛或被疏毛。叶互生，叶片心形；先端渐尖，上表面绿色，密生腺点，下表面常紫红色；叶柄细长，基部与托叶合生成鞘状。穗状花序顶生。具鱼腥气，味涩。益母草（B错）：【性状鉴别】饮片鲜益母草幼苗期无茎，基生叶圆心形，5～9浅裂，每裂片有2～3钝齿。花前期茎呈方柱形，上部多分枝，四面凹下成纵沟；表面青绿色；质鲜嫩，断面中部有髓。叶交互对生，有柄；叶片青绿色，质鲜嫩，揉之有汁；下部茎生叶掌状3裂，上部叶羽状深裂或浅裂成3片，裂片全缘或具少数锯齿。气微，味微苦。金钱草（C错）：【性状鉴别】饮片为不规则的段。茎棕色或暗棕红色，有纵纹，实心。叶对生，展平后呈宽卵形或心形，上表面灰绿色或棕褐色，下表面色较浅，主脉明显突出，用水浸后，对光透视可见黑色或褐色的条纹；偶见黄色花，单生叶腋。气微，味淡。半枝莲（E错）：【性状鉴别】饮片为不规则的段。茎方柱形，中空，表面暗紫色或棕绿色。叶对生，多破碎；上表面暗绿色，下表面灰绿色。花萼裂片钝或较圆；花冠唇形，棕黄色或浅蓝紫色，被毛。果实扁球形，浅棕色。气微，味微苦。